某男，25岁。流感初起，症见发热恶寒、无汗、头痛、鼻塞、喷嚏、咽痒咳嗽、四肢酸痛。宜选用的中成药是
A. 九味羌活丸
B. 连花清瘟胶囊
C. 羚羊感冒胶囊
D. 清暑益气丸
E. 正柴胡饮颗粒

正确答案：E。正柴胡饮颗粒

解析：本题考查正柴胡饮颗粒的主治。宜选用的中成药是正柴胡饮颗粒（E对）。正柴胡饮颗粒【主治】外感风寒所致的感冒，症见发热恶寒、无汗、头痛、鼻塞、喷嚏、咽痒咳嗽、四肢酸痛；流感初起、轻度上呼吸道感染见上述证候者。九味羌活丸（A错）（颗粒、口服液）【主治】外感风寒挟湿所致的感冒，症见恶寒、发热、无汗、头重而痛、肢体酸痛。连花清瘟胶囊（B错）【主治】流行性感冒属热毒袭肺证，症见发热、恶寒、肌肉酸痛、鼻塞流涕、咳嗽、头痛、咽干咽痛、舌偏红、苔黄或黄腻。羚羊感冒胶囊（C错）【主治】流行性感冒，症见发热恶风、头痛头晕、咳嗽、胸闷、咽喉肿痛。清暑益气丸（D错）【主治】中暑受热，气津两伤，症见头晕身热、四肢倦怠、自汗心烦、咽干口渴。